下列不属于综合性服务四个方面的是
A. 服务内容
B. 服务范围
C. 服务对象
D. 服务种类
E. 服务方式

正确答案：D。服务种类

解析：本题考查社区卫生服务的综合性服务的方面。社区卫生服务综合性服务的内容可以分为服务对象（C对）、服务内容（A对）、服务层面、服务范围（B对）、服务方式（E对）。服务种类（D错，为本题正确答案）不属于综合性服务。